《中国药典》中制剂通则收载在
A. 前言部分
B. 凡例部分
C. 正文部分
D. 附录部分
E. 索引部分

正确答案：D。附录部分